患者，男，40岁。颅脑术后第5天，但持续高热4天，全身浮肿，近2天每日尿量不足l00mL，血尿素氮260mmol/L，血肌酐＞740μmol/L，血钾6.6mmol/L。其诊断是
A. 急性肾衰竭
B. 休克
C. 心力衰竭
D. 肝肾综合征
E. 以上均非

正确答案：A。急性肾衰竭

解析：心力衰竭的诊断标准是根据基础心脏病史，突然出现典型的急性心衰症状，如严重乏力，呼吸困难，端坐呼吸，烦躁不安，皮肤湿冷，频发咳嗽，甚至咳粉红色泡沫样痰，听诊心率增快，双肺或肺底闻及哮鸣音或湿罗音，舒张期奔马律，P₂亢进，据症状和体征可以诊断此病为心力衰竭（C错）。急性肾损伤曾称急性肾衰竭。肾衰竭的诊断标准为：①症状：急性少尿（＜400mL/24h），或无尿（＜100mL/24h），烦躁、嗜睡、意识障碍。②体征：水肿、高血压。③肾功能：血尿素氮、血肌酐进行性上升，血钾＞6.5mmol/L，酸碱平衡紊乱（A对）。休克（B错）表现为低血压，尿少，神志昏迷等表现；肝肾综合征（D错）表现为少尿，无尿，氮质血症，稀释性低钠血症，低尿钠。